注射用硫喷妥钠的含量测定方法为
A. 碘量法
B. 溴量法
C. 银量法
D. 紫外分光光度法
E. 可见分光光度法

正确答案：D。紫外分光光度法